黄芪中的皂苷是
A. 强心苷
B. 腺苷
C. 吲哚苷
D. 鸟苷
E. 三萜皂苷

正确答案：E。三萜皂苷

解析：本题考查的是黄芪的化学成分。黄芪中的皂苷是三萜皂苷（E对）。黄芪的化学成分众多，主要含皂苷类、黄酮类、多糖类及氨基酸类等。黄芪皂苷具有多种生物活性，其中黄芪甲苷是黄芪中主要生理活性成分。在黄芪及其同属近缘植物中共分离出40余种三萜皂苷。《中国药典》以黄芪甲苷和毛蕊异黄酮葡萄糖苷为指标成分进行药材和饮片的含量测定，要求药材含黄芪甲苷不得少于0.080%，饮片含黄芪甲苷不得少于0.060%；要求药材和饮片含毛蕊异黄酮葡萄糖苷不得少于0.020%。强心苷（A错）是存在于生物界中的一类对心脏有显著生理活性的甾体苷类。主要分布于夹竹桃科、玄参科、百合科、萝藦科、十字花科、毛茛科和桑科等。动物中至今尚未发现强心苷成分，中药蟾酥是一类具有强心作用的甾体化合物，但不属于苷类，属于蟾毒配基的脂肪酸酯类。腺苷（B错）与鸟苷（D错）均属于氮苷。吲哚苷（C错）：如靛苷，其苷元吲哚醇无色，易氧化成蓝色的靛蓝。